某男，58岁。患类风湿性关节炎，筋骨关节疼痛，肿胀麻木重着，屈伸不利，遇寒加重。诊断为痹证，证属着痹（寒湿痹阻），宜选用的中成药是
A. 九味羌活丸
B. 痹痛宁胶囊
C. 天麻丸
D. 独活寄生合剂
E. 四妙丸

正确答案：B。痹痛宁胶囊

解析：本题考查痹症之着痹的中成药应用。结合患者症状为痹症之着痹，宜选用中成药为痹痛宁胶囊（B对）。痹症之着痹【症状】肢体关节、肌肉酸楚、重着、疼痛，肿胀散漫，关节活动不利，肌肤麻木不仁。舌质淡，舌苔白腻，脉濡缓。风湿痹康胶囊、痹痛宁胶囊、湿热痹颗粒。痹证之行痹【症状】肢体关节、肌肉疼痛酸楚，关节屈伸不利，可涉及肢体多个关节，疼痛呈游走性，初起可见恶风、发热等表证。舌苔薄白，脉浮或浮缓。【中成药应用】常用药为九味羌活丸（A错）。痹症尪痹【症状】痹证日久不愈，肢体、关节疼痛，屈伸不利，关节肿大僵硬、变形，甚则肌肉萎缩，筋脉拘急，肘膝不伸，或以尻代踵，以背代头，伴腰膝酸软、骨蒸潮热、自汗、盗汗。舌红或淡，脉细数。【中成药应用】常用药为天麻丸（C错）、独活寄生合剂（D错）、尪痹颗粒、益肾蠲痹丸。腰痛之湿热腰痛【症状】腰部疼痛，重着而热，暑湿阴雨天气症状加重，活动后或可减轻，身体困重，小便短赤。舌质红，苔黄腻，脉濡数或弦数。【中成药应用】常用中成药三妙丸、四妙丸（E错）、湿热痹颗粒、 豨莶丸、风湿圣药胶囊。